西咪替丁的抗消化性溃疡作用主要是由于
A. 阻断胃壁H⁺泵
B. 阻断5-HT受体
C. 阻断H₂受体
D. 阻断M受体
E. 阻断DA受体

正确答案：C。阻断H₂受体

解析：本题考查西咪替丁的不良反应。组胺与胃壁细胞的H₂受体结合，从而激活胃壁细胞的H⁺泵，促进胃酸分泌。西咪替丁通过阻断H₂受体（C对）而抑制胃酸分泌，从而发挥抗消化性溃疡的作用。奥美拉唑属于质子泵抑制剂类抑酸剂（A错），与胃黏膜壁细胞内H⁺，K⁺-ATP酶特异性结合形成复合物，抑制后者活性，从而抑制胃酸生成，该作用表现出较高的选择性、专一性、不可逆性和持久性。通过阻断5-HT受体（B错）不能减少胃酸分泌。M受体阻断剂（D错）在消化道运动方面常为解痉药，如阿托品、山莨菪碱等。DA受体阻断剂（E错）为常用的促胃肠动力药，常用的有甲氧氯普胺，多潘立酮等。